静脉畸形穿刺可抽出
A. 血液
B. 蛋清样黏液
C. 乳白色豆渣样分泌物
D. 黄绿色清亮物质
E. 黄绿色脓性物质

正确答案：A。血液

解析：穿刺检查：通过穿刺抽吸肿块内容物，了解内容物的颜色、透明度、黏稠度等性质，可以进一步协助诊断，例如：静脉畸形可有血液抽出；舌下腺囊肿有蛋清样黏液抽出；脓肿可以抽出脓液。必要时抽出物还应送病理或涂片检查，以进一步确定其性质。掌握“口外一般检查及辅助检查”知识点。